长期肠外营养支持者，应选择的穿刺血管是
A. 颈内静脉
B. 大隐静脉
C. 颈外静脉
D. 足背静脉
E. 头静脉

正确答案：A。颈内静脉

解析：肠外营养的输注途径主要有中心静脉和周围静脉途径。长期肠外营养支持者应采用中心静脉途径，常用的穿刺血管为颈内静脉（A对）、锁骨下静脉、头静脉或贵要静脉。按照九版外科学观点：头静脉（E对）也为应选的穿刺血管。大隐静脉（B错）、颈外静脉（C错）、足背静脉（D错）均为表浅静脉，可作为周围静脉途径（主要用于只需短期肠外营养者）的穿刺血管。